下列关于肺的说法何者正确
A. 位于纵隔两侧的胸膜腔内
B. 肺尖位置在胸廓上口平面
C. 表面有脏胸膜覆盖，并深入肺的叶间裂
D. 内侧面的下部有椭圆形的肺门
E. 肺的下缘在深吸气时可深入肋膈隐窝

正确答案：C。表面有脏胸膜覆盖，并深入肺的叶间裂

解析：肺位于胸腔内（A错）。肺尖经胸廓上口突入颈根部（B错）。肺表面有脏胸膜覆盖，并深入肺的叶间裂（C对）。肺内侧面的中央有椭圆形的肺门（D错）。即使在深吸气时，肺缘也达不到肋膈隐窝（E错）。